某黄酮化合物的醇溶液，加入二氯氧锆甲醇液呈鲜黄色，再加入枸橼酸甲醇液，黄色不褪表示该化合物具有
A. C₅-OH
B. C₇-OH
C. C₃-OH
D. C₆-OH
E. C₈-OH

正确答案：C。C₃-OH

解析：本题考查的是黄酮的与金属盐类试剂的络合反应。某黄酮化合物的醇溶液，加入二氯氧锆甲醇液呈鲜黄色，再加入枸橼酸甲醇液，黄色不褪表示该化合物具有而C₃-OH（C对）。黄酮与锆盐试剂的络合反应：多用2%二氯氧化锆甲醇溶液。黄酮类化合物分子中有游离的3-羟基或5-羟基存在时，均可与该试剂反应生成黄色的锆络合物。但两种锆络合物对酸的稳定性不同。3羟基、4-酮基络合物的稳定性比5-羟基、4-酮基络合物的稳定性强（但二氢黄酮醇除外）。故当反应液中加入枸橼酸后，5-羟基（A错）黄酮的黄色溶液显著褪色，而3-羟基黄酮溶液仍呈鲜黄色（锆-枸橼酸反应）。方法是取样品0.5～1.0mg，用10.0ml甲醇加热溶解，加1.0ml2%二氯氧化锆（ZrOCl₂）甲醇液，呈黄色后再加入2%枸橼酸甲醇液，观察颜色变化。